下列哪种农药口服中毒时不能用NaHCO₃溶液洗胃
A. 内吸磷
B. 对硫磷
C. 美曲膦酯（敌百虫）
D. 马拉硫磷
E. 乐果

正确答案：C。美曲膦酯（敌百虫）